某医学生希望毕业后成为外科医生，在临床实习中主动向老师请教，积极为患者服务，并能结合临床案例查阅相关书籍和文献。他的行为表现在意志品质中属于
A. 自觉性
B. 果断性
C. 坚韧性
D. 自制性
E. 独立性

正确答案：A。自觉性